医师注册后应当由卫生行政部门注销注册的情形之一是
A. 受罚款行政处罚
B. 受警告行政处罚
C. 受责令暂停6个月执业活动的行政处罚
D. 中止医师执业活动满1年的
E. 受吊销执业证书行政处罚的

正确答案：E。受吊销执业证书行政处罚的

解析：注销注册：医师注册后有下列情形之一的，其所在的医疗、预防、保健机构应当在30日内报告准予注册的卫生行政部门，卫生行政部门应当注销注册，收回医师执业证书：①死亡或者被宣告失踪的；②受刑事处罚的；③受吊销医师执业证书行政处罚的；④因考核不合格，暂停执业活动期满，经培训后再次考核仍不合格的；⑤中止医师执业活动满2年的；⑥有国务院卫生行政部门规定不宜从事医疗、预防、保健业务的其他情形的。掌握“执医概述及考试和注册”知识点。